通过置换产生药物作用的是
A. 华法林与保泰松合用引起出血
B. 奥美拉唑治疗胃溃疡可使水杨酸和磺胺类药物疗效下降
C. 考来烯胺与阿司匹林
D. 对氨基水杨酸与利福平合用，使利福平疗效下降
E. 抗生素合用抗凝药，使抗凝药疗效增加

正确答案：A。华法林与保泰松合用引起出血

解析：本题考查药物的相互作用。通过置换产生药物作用的是华法林与保泰松合用引起出血（A对）。华法林和保泰松的血浆蛋白结合率均很高，两者合用时保泰松常占据更多的血浆蛋白，将部分华法林从血浆蛋白中置换出来，从而加强华法林的抗凝作用，甚至引起抗凝过度而出血。奥美拉唑治疗胃溃疡可使水杨酸和磺胺类药物疗效下降（B错）是通过影响药物解离度产生药物作用。考来烯胺与阿司匹林（C错）是通过影响吸附作用产生药物作用。对氨基水杨酸与利福平合用，使利福平疗效下降（D错）是通过影响胃肠道的吸收产生药物作用。抗生素合用抗凝药，使抗凝药疗效增加（E错）是通过影响肠道菌群产生药物作用。